多见于舌侧尖、腭侧尖及舌面的缺损主要原因为
A. 龋病
B. 外伤
C. 磨损
D. 酸蚀症
E. 楔状缺损

正确答案：D。酸蚀症

解析：内源性酸损害常见于上消化道疾病患者长期反酸等引起口腔牙齿的酸蚀，多见于舌侧尖、腭侧尖及舌面的缺损。掌握“牙体缺损病因及影响”知识点。